循行于内踝尖八寸以上下肢内侧前缘的经脉是
A. 足少阳胆经
B. 足少阴肾经
C. 足厥阴肝经
D. 足太阴脾经
E. 足阳明胃经

正确答案：D。足太阴脾经

解析：下肢内侧分为三阴，内踝尖上8寸以下是厥阴在前、太阴在中、少阴在后；内踝尖上8寸以上是太阴在前（D对）、厥阴在中、少阴在后。